卫生标准规定理发刀具、胡须刷、毛巾不得检出的细菌是
A. 链球菌和白色葡萄球菌
B. 大肠杆菌和金黄色葡萄球菌
C. 枯草杆菌和链球菌
D. 枯草杆菌和微球菌
E. 所有杂菌

正确答案：B。大肠杆菌和金黄色葡萄球菌

解析：本题考查卫生标准规定理发刀具、胡须刷、毛巾不得检出的细菌。《理发店、美容店卫生标准》（GB 9666-1996）规定，理发刀具、胡须刷、毛巾不得检出大肠菌群和金黄色葡萄球菌（B对ACDE错）。